一个tRNA反密码子为5'IGC3'，它可以识别的密码是
A. 5'GCA3'
B. 5'GCG3'
C. 5'CCG3'
D. 5'ACG3'
E. 5'UCG3'

正确答案：A。5'GCA3'